四环素在牙体组织中沉积的量最少的是
A. 牙釉质
B. 牙本质
C. 牙骨质
D. 下颌骨
E. 肱骨

正确答案：A。牙釉质

解析：四环素对牙和骨有亲和性，牙体组织中，除牙本质外四环素还可沉积于牙骨质，但釉质中有四环素条带者少见。掌握“四环素牙”知识点。